乳牙和年轻恒牙龋病预防和治疗原则包括
A. 分析原因
B. 治疗活动龋
C. 口腔卫生宣教
D. 早发现、早诊断、早治疗
E. A+B+C+D

正确答案：E。A+B+C+D

解析：本题考查龋病的预防方法和治疗原则。龋病的预防方法为三级预防：一级预防：进行口腔健康教育，普及口腔健康知识等口腔卫生宣教（C对）。控制及消除危险因素，对口腔内存在的危险因素，首先应分析原因（A对），采取可行的防治措施。二级预防：定期进行临床诊断及X线辅助检查，早期发现、早期诊断、早期治疗（D对），积极治疗活动性的龋病（B对）。三级预防：防止龋病的并发症，对龋病引起的牙髓炎、根尖周炎应进行恰当治疗，防止炎症继续发展；对不能保留的牙应及时拔除。（ABCD均对，故E为本题的正确答案）。